水的碳酸盐硬度指
A. 溶解性固体和悬浮性固体
B. 钙、镁的重碳酸盐
C. 钙、镁的硫酸盐和氧化物
D. 水中不能除去的钙、镁盐类
E. 溶解于水中的钙、镁盐类总和

正确答案：B。钙、镁的重碳酸盐

解析：本题考查水的碳酸盐硬度。硬度指溶于水中钙、镁盐类的总含量，以CaCO₃（mg/L）表示。水的硬度一般分为碳酸盐硬度和非碳酸盐硬度，碳酸盐硬度指钙、镁的重碳酸盐和碳酸盐（B对ACDE错），非碳酸盐硬度指钙、镁的硫酸盐、氯化物等。